2017年1月21日，国务院发布《第三批取消中央指定地方实施行政许可事项的决定》（国发〔2017〕7号），其中取消了互联网药品交易服务企业审批（第三方平台除外）行政许可事项。2017年9月29日，《国务院关于取消一批行政许可事项的决定》（国发〔2017〕46号）发布，决定取消互联网药品交易服务企业（第三方平台）审批的行政许可事项。2017年11月1日，国家食品药品监合管理总局发布《总局办公厅关于加强互联网药品医疗器械交易监管工作的通知》（食药监办法〔2017〕144号），就加强互联网药品、医疗器械交易监管工作，做好相关事中事后监督管理措施的衔接工作，作出了明确规定。在取消品交易服务企业审批事项之后，关于上述信息中的从事互联网药品交易服务资格以及药品交易合法性的说法，正确的是
A. 药品零售连锁企业可以直接向个人消费者提供互联网药品交易服务，在网上销售本企业经营的药品
B. 药品生产企业可以直接将其他企业生产的药品通过自身网站与医疗机构进行互联网药品交易
C. 药品监督管理部门应强化事中事后监督管理明确通过第三方平台从事活动的必须是取得药品生产、经营许可的企业和医疗机构，落实平台的主体责任
D. 药品批发企业可以直接通过自身网站向个人消费者提供互联网药品交易服务

正确答案：C。药品监督管理部门应强化事中事后监督管理明确通过第三方平台从事活动的必须是取得药品生产、经营许可的企业和医疗机构，落实平台的主体责任

解析：本题考查的是网络药品经营管理。2017年1月21日，国务院发布《第三批取消中央指定地方实施行政许可事项的决定》（国发〔2017〕7号），其中取消了互联网药品交易服务企业审批（第三方平台除外）行政许可事项。2017年9月29日，《国务院关于取消一批行政许可事项的决定》（国发〔2017〕46号）发布，决定取消互联网药品交易服务企业（第三方平台）审批的行政许可事项。2017年11月1日，国家食品药品监合管理总局发布《总局办公厅关于加强互联网药品医疗器械交易监管工作的通知》（食药监办法〔2017〕144号），就加强互联网药品、医疗器械交易监管工作，做好相关事中事后监督管理措施的衔接工作，作出了明确规定。在取消品交易服务企业审批事项之后，关于上述信息中的从事互联网药品交易服务资格以及药品交易合法性的说法，正确的是药品监督管理部门应强化事中事后监督管理明确通过第三方平台从事活动的必须是取得药品生产、经营许可的企业和医疗机构，落实平台的主体责任（C对）。2017年，国务院两次发布取消行政许可事项的决定，全面取消了实施12年的“互联网药品交易服务企业审批”许可事项，并明确国家药品监管部门通过以下措施加强事中事后监管：①制定相关管理规定，要求属地食品药品监管部门将平台网站纳入监督检查范围，明确通过平台从事活动的必须是取得药品生产、经营许可的企业和医疗机构，落实平台的主体责任；②建立网上售药监测机制，畅通投诉举报渠道，建立“黑名单”制度；③加大监督检查力度，加强互联网售药监管，严厉查处网上非法售药行为。